某男，72岁。口渴多饮、消瘦2年。曾住院治疗，诊断为2型糖尿病，长期服用西药降糖药。因症状控制不良，请中医诊治。现患者烦渴引饮，消谷善饥，小便频数而多，尿浊而黄。舌红苔薄黄少津，脉数。治宜选用的方剂是
A. 参苓白术散
B. 玉女煎
C. 杞菊地黄丸
D. 八珍汤
E. 金匮肾气丸

正确答案：B。玉女煎

解析：本题考查的是消渴的辨证论治。患者烦渴引饮，消谷善饥，小便频数而多，尿浊而黄。舌红苔薄黄少津，脉数。治宜选用的方剂是玉女煎（B对）。消渴是以多饮、多食、多尿、乏力、消瘦，或尿有甜味为主要临床表现的疾病。其中以口渴多饮为主者称为“上消”；消谷善饥为主者称为“中消”；小溲多而频，或浑浊为特点的称为“下消”。三者也可并见。西医学的糖尿病、尿崩症和精神性多饮、多尿症等以上述临床表现为主者，可参考此内容辨证论治。（一）阴虚燥热证：【症状】烦渴引饮，消谷善饥，小便频数而多，尿浑而黄，形体消瘦。舌红，苔薄黄，脉滑数。【方剂应用】基础方剂为玉女煎（生石膏、熟地、麦冬、知母、牛膝）加减。（二）脾胃气虚证：【症状】口渴引饮，能食与便溏并见，或饮食减少，精神不振，四肢乏力。舌淡，苔薄白而干，脉细弱无力。【方剂应用】基础方剂为参苓白术散（A错）（莲子肉、薏苡仁、砂仁、桔梗、白扁豆、白茯苓、人参、甘草、白术、山药）加减。（三）气阴两虚证：【症状】口渴引饮，能食与便溏并见，或饮食减少，精神不振，四肢乏力，体瘦。舌质淡红，苔白而干，脉弱。【方剂应用】基础方剂为七味白术散（人参、茯苓、白术、藿香叶、木香、甘草、葛根）加减，可合生脉散益气生津止渴。（四）肾阴亏虚证：【症状】尿频量多，浊如膏脂，腰酸膝软，头晕耳鸣，多梦遗精，乏力，皮肤干燥。舌红少苔，脉细数。【方剂应用】基础方剂为六味地黄丸（熟地黄、山茱萸、山药、泽泻、丹皮、茯苓）加减。（五）阴阳两虚证：【症状】小便频数，甚则饮一溲一，咽干舌燥，面容憔悴，耳轮干枯，腰膝酸软，畏寒肢冷。舌淡，苔白少津，脉沉细无力。【方剂应用】基础方剂为肾气丸（地黄、山药、山萸肉、泽泻、茯苓、丹皮、桂枝、附子）加减。【中成药应用】常用中成药有金匮肾气丸（E错）。八珍汤（D错）为积聚正虚邪结证的方剂应用。积聚正虚邪结证：【症状】久病体弱，积块坚硬，隐痛或剧痛，饮食大减，肌肉瘦削，神倦乏力，面色萎黄或黧黑，甚则面肢浮肿。舌质淡紫，或光剥无苔，脉细数或弦细。【方剂应用】基础方剂为八珍汤（当归、川芎、熟地黄、白芍、人参、炙甘草、茯苓、白术）合化积丸（三棱、莪术、阿魏、海浮石、香附、雄黄、槟榔、苏木、瓦楞子、五灵脂）加减。方剂应用为杞菊地黄丸（C错）的病证，2022年考试指南未明确说明。